男孩，1岁。近2个月夜间睡眠打鼾，侧卧好转，感冒时加重。造成患儿睡眠打鼾的呼吸系统解剖生理基础是
A. 肺通气储备少
B. 肺活量少
C. 潮气量少
D. 咽狭腔狭小
E. 气体弥散量小

正确答案：D。咽狭腔狭小

解析：患儿1岁，睡眠打鼾，侧卧好转，感冒时加重。最可能的诊断为阻塞性睡眠综合征，病因首先考虑咽扁桃体肿大。婴幼儿本身咽腔即狭小且垂直，咽扁桃体肿大加重狭小，导致患儿睡眠打鼾（D对）。